甲状腺髓样癌是一种
A. 交界性肿瘤
B. 鳞癌
C. 未分化癌
D. 迷离瘤
E. 神经内分泌肿瘤

正确答案：E。神经内分泌肿瘤

解析：甲状腺髓样癌是由滤泡旁降钙素分泌细胞（即甲状腺C细胞）发生的恶性肿瘤， 滤泡旁降钙素分泌细胞属于APUD细胞（神经内分泌细胞）（P322），故甲状腺髓样癌是一种神经内分泌肿瘤（E对）。交界性肿瘤（P95）（A错）是指介于良性和恶性之间的肿瘤。鳞癌（P97）（B错）是一种发生于上皮组织的恶性肿瘤，多见于有鳞状上皮覆盖或可发生鳞状上皮化生的部位。未分化癌（P84）（C错）是指缺乏细胞分化特征的恶性肿瘤，可见于甲状腺癌（P317）、肺癌（P183）、胃癌（P209）等。迷离瘤（二版八年制病理学P128）（D错）指分化正常的组织误位于异常部位而形成的包块。